下列哪种粉尘对呼吸系统无致癌作用
A. 石英
B. 石棉
C. 镍尘
D. 铬酸盐尘
E. 铀矿尘

正确答案：A。石英